呼吸性酸中毒所致的电解质紊乱为
A. 低钾血症
B. 高钠血症
C. 低钙血症
D. 高氯血症
E. 低氯血症

正确答案：E。低氯血症

解析：在呼吸性酸中毒，由于呼吸功能障碍，导致能量供应不足，机体内转运离子的钠泵功能障碍，使细胞内K⁺转移至血液，而Na⁺和H⁺进入细胞内，首先造成细胞内酸中毒和高钾血症。慢性呼吸衰竭时，肾脏可通过减少HCO₃⁻的排出来维持PH恒定，又因血中主要阴离子HCO₃⁻和Cl⁻之和相对恒定（电中性原理），当HCO₃⁻持续增加时血中Cl⁻相应降低，产生低氯血症（E对）。